动物实验结果表明洗涤剂基本属于低毒或微毒化学物质，表面活性剂对大鼠经口LD₅₀范围一般为
A. 10～100mg/kg
B. 50～200mg/kg
C. 100～500mg/kg
D. 1000～15000mg/kg
E. 100000～150000mg/kg

正确答案：D。1000～15000mg/kg

解析：本题考查表面活性剂对大鼠经口LD₅₀范围。动物实验结果表明洗涤剂基本属于低毒或微毒化学物质，表面活性剂对大鼠经口LD₅₀范围一般为1000～15000mg/kg（D对ABCE错）。